下列不属于急性重型肝炎典型表现的是
A. 黄疸迅速加深
B. 出血倾向明显
C. 肝大
D. 出现烦躁、谵妄等神经系统症状
E. 急性肾功能不全

正确答案：C。肝大

解析：急性重型肝炎，肝细胞大块坏死或亚大块坏死或桥接坏死，坏死肝细胞占2/3以上，周围中性粒细胞浸润，无纤维组织增生，也无明显的肝细胞再生，肝脏体积缩小，故肝大不属于急性重型肝炎典型的表现（C错，为本题正确答案）。急性重型肝炎肝细胞大量坏死，血中游离胆红素增高，故黄疸迅速加深（A对）；凝血因子主要在肝脏中产生，故急性重型肝炎肝细胞大量坏死，凝血因子减少，故出血倾向明显（B对）；急性重型肝炎极易诱发肝性脑病，出现烦躁、谵妄等神经系统症状（D对）；急性重型肝炎晚期常出现肝肾综合征，发生急性肾功能不全（E对），是严重肝病的终末期表现。